患者女，32岁，孕2周，既往有癫痫病史，长期服用卡马西平治疗，为防止引起新生儿出血，该患者妊娠晚期应当补充的维生素是
A. 维生素D
B. 维生素K
C. 叶酸
D. 维生素B₁₂
E. 维生素B₂

正确答案：B。维生素K

解析：本题考查维生素K。患者妊娠晚期出现题干症状应当补充的维生素是维生素K（B对）。维生素K₁为促凝血因子合成药，是肝脏合成凝血因子Ⅱ、Ⅶ、Ⅸ、X所必需的物质，维生素K₁缺乏会引起这些凝血因子合成障碍，引起出血倾向和凝血酶原时间延长，对接受抗癫痫药治疗的妇女，为降低神经血管缺陷的风险，建议在妊前或妊期补充叶酸（C错）；维生素D（A错）用于预防和治疗维生素D缺乏症，如佝偻病等；维生素B₁₂（D错）用于巨幼红细胞性贫血；维生素B₂（E错）用于预防和治疗维生素B₂缺乏症。